含有氢氯噻嗪，与西药降压药厄贝沙坦氢氯噻嗪片联用可增加低血钾风险的中成药是
A. 重感灵片
B. 脉君安片
C. 强力感冒片
D. 藿香正气水
E. 通心络胶囊

正确答案：B。脉君安片

解析：本题考查脉君安片中的西药组分。含有氢氯噻嗪，与西药降压药厄贝沙坦氢氯噻嗪片联用可增加低血钾风险的中成药是脉君安片（B对）。脉君安片【含西药组分】氢氯噻嗪。重感灵片（A错）【含西药组分】马来酸氯苯那敏、安乃近。强力感冒片（C错）【含西药组分】对乙酰氨基酚。藿香正气水（D错）（乙醇含量40%～50%）、柏子养心丸（片）（朱砂含量3.8%）。《中国药典》收载的妊娠禁用、忌用的主要品种有：二十七味定坤丸、十一味能消丸、通心络胶囊（E错）。